胃液中激活胃蛋白酶原、促进铁的吸收的成分是
A. HCl
B. 内因子
C. 黏液
D. 碳酸氢盐
E. 维生素B₁₂

正确答案：A。HCl